下列关于淋病奈瑟球菌的叙述中，正确的是
A. 主要经呼吸道传播
B. 为G+球菌
C. 可产生自溶酶
D. 大多无荚膜和菌毛
E. 人是淋菌的唯一宿主

正确答案：E。人是淋菌的唯一宿主

解析：淋病奈瑟球菌所致疾病人类是淋病奈瑟菌唯一宿主，成人淋病主要经性接触传播。掌握“肠球菌属及奈瑟菌属”知识点。